青年甲在筹备结婚过程中，连续多日劳累，患化脓性扁桃腺炎。医生在为其诊察中同时发现患有淋病。患者住院4天，扁桃腺炎痊愈出院，医生嘱其充分休息。按照母婴保健法，甲
A. 不能结婚
B. 应当暂缓结婚
C. 可以结婚，但不能生育
D. 可以结婚，治愈后可生育
E. 不影响结婚生育

正确答案：B。应当暂缓结婚

解析：淋病属于性传播疾病，结婚后会传播给另一方，且可经母婴传播传染给胎儿，因此，结婚（CD错）和生育（E错）对于尚未治愈的患者都不合适，按照母婴保健法，甲应当暂缓结婚（B对）。不能结婚（A错）仅限于《婚姻法》明确禁止的情况，淋病属于可以治愈的疾病，治愈后不影响结婚和生育。